可以酸化尿液，用于代谢性碱中毒的药品是
A. 氯化钾
B. 乳酸钠
C. 谷氨酸
D. 硫酸镁
E. 氯化铵

正确答案：E。氯化铵

解析：本题考查氯化钠。可以酸化尿液，用于代谢性碱中毒的药品是氯化铵（E对）。氯化铵适应证：①干咳以及痰不易咳出等。②酸化尿液。③纠正代谢性碱中毒。乳酸钠（B错）临床适用于代谢性酸中毒，碱化体液或尿液，用于高钾血症或普鲁卡因胺引起的心律失常伴有酸血症者。